属于三环类抗抑郁药的是
A. 异戊巴比妥
B. 阿米替林
C. 格鲁米特
D. 氯硝西泮
E. 甲丙氨酯

正确答案：B。阿米替林

解析：本题考查三环类抗抑郁药。属于三环类抗抑郁药的是阿米替林（B对）。阿米替林为三环类抗抑郁药，主要通过抑制突触前膜对5-HT及去甲肾上腺素的再摄取，使突触间隙的去甲肾上腺素和5-HT浓度升高，促进突触传递功能而发挥抗抑郁作用。异戊巴比妥（A错）为巴比妥类镇静催眠药。格鲁米特（C错）为镇静催眠抗惊厥药。氯硝西泮（D错）为苯二氮䓬类镇静催眠药。甲丙氨酯（E错）为非苯二氮䓬类抗焦虑药。